14～18岁青少年钙的RNI从儿童期的800mg/d增加到
A. 850mg/d
B. 900mg/d
C. 950mg/d
D. 1000mg/d
E. 1050mg/d

正确答案：D。1000mg/d

解析：本题考查14～18岁青少年钙的RNI。14～18岁青少年钙的RNI从儿童期的800mg/d增加到1000mg/d（D对ABCE错）。